下列哪项是乙肝病毒复制指标
A. HBsAg
B. 抗HBe
C. 抗HBs
D. HBeAg
E. 抗HBeIgG

正确答案：D。HBeAg

解析：乙型肝炎病毒（HBV）有三个抗原抗体系统，即表面抗原与抗体、核心抗原与抗体、e抗原与抗休。①乙型肝炎病毒表面抗原和抗体即HBsAg与抗HBs，还包括前S1和前S2抗原与其抗体。②乙型肝炎病毒核心抗原和抗体乙型肝炎核心抗原（HBcAg）存在于肝细胞核内，不易检出；抗HBc是HBcAg相应的抗体，有抗HBcIgM和抗HBcIgG两型，前者存在于乙型肝炎的急性期（一般持续6个月）或慢性乙型肝炎的急性发作期。③乙型肝炎病毒e抗原和e抗体HBeAg稍后（或同时）于HBsAg在血中出现，与Dane颗粒及DNAP密切相关，为HBV活动性复制和传染性强的标志。掌握“病毒性肝炎”知识点。